以下不是“扳机点”在下颌支的部位的是
A. 颏孔
B. 下唇
C. 上颌结节
D. 耳屏部
E. 颊黏膜

正确答案：C。上颌结节

解析：“扳机点”在下颌支的部位：颏孔、下唇、口角区、耳屏部、颊黏膜、颊脂垫尖、舌颌沟等处，并须观察在开闭口及舌运动时有无疼痛的发作。掌握“三叉神经痛”知识点。